主动脉瓣关闭不全心脏X线检查的表现是
A. 左房增大
B. 右房增大
C. 左室增大
D. 右室增大
E. 左房右室明显增大

正确答案：C。左室增大

解析：左心室增大常见的原因为高血压、主动脉瓣关闭不全或狭窄、二尖瓣关闭不全及部分先天性心脏病（如动脉导管未闭）等（C对）。左心房增大常见于二尖瓣病变、左心衰竭和一些先天性心脏病（如动脉导管未闭等（A错）。右心房增大见于右心衰竭、房间隔缺损、三尖瓣病变（B错）。右心室增大的常见原因为二尖瓣狭窄、慢性肺源性心脏病、肺动脉瓣狭窄、肺动脉高压、心内间隔缺损和法洛四联症等（D错）。左房右室明显增大常见于肺心病、冠心病、风心病二尖瓣狭窄（E错）。